患者，女，26岁，产后7周，正在哺乳，尚未恢复月经，自述有阴道炎及严重偏头痛。目前宜选用的避孕方法是
A. 采用安全期避孕
B. 口服短效复方避孕药
C. 使用避孕套
D. 口服紧急避孕药
E. 放置左炔诺孕酮宫内节育系统

正确答案：C。使用避孕套

解析：本题考查女性避孕的常用方法。哺乳期尽量避免使用药物进行避孕，可采用如男性使用避孕套（C对）的方式不影响女性哺乳。